唾液功能有
A. 机械清洁
B. 润滑和保护
C. 缓冲作用
D. 抗微生物
E. 以上都是

正确答案：E。以上都是

解析：本题考查唾液的功能。唾液是一种维持口腔健康的重要体液，每昼夜平均分泌600mL唾液，由三对大唾液腺和许多小唾液腺分泌，也有龈沟液的掺入。唾液具有润滑（B对）、缓冲（C对）、清洁（A对）、抗微生物（D对）、凝集、薄膜形成、消化等多种功能，是宿主口腔免疫防御系统的重要组成部分之一。唾液的保护作用与其有效成分、流量、流速有密切联系，唾液功能失调会导致严重的口腔软硬组织疾患。唾液的物理特性可以起到生理性保护作用。有效的唾液流量/流速可以提供必要的润滑作用，帮助运送食物、清除细菌和脱落的上皮以及不断补充新鲜的抗菌成分，如溶菌酶、乳铁蛋白、过氧化氢酶、富组蛋白以及免疫球蛋白。唾液的缓冲作用对保持牙釉质的动态平衡是非常关键的。唾液物理特性的改变，如流量/流速的减少或缓冲作用的降低都将导致唾液防御功能的下降，进而引起龋齿和牙周疾病的发生和发展。（ABCD均对，故E为本题的正确答案）。